六合定中丸除和胃消食外，又能
A. 辟瘟解毒
B. 祛暑除湿
C. 清热解毒
D. 益气生津
E. 祛风除湿

正确答案：B。祛暑除湿

解析：本题考查的是六合定中丸的功能。六合定中丸除和胃消食外，又能祛暑除湿（B对）。六合定中丸：【功能】祛暑除湿，和中消食。紫金锭：【功能】辟瘟解毒（A错），消肿止痛。甘露消毒丸：【功能】芳香化湿，清热解毒（C错）。益心舒胶囊：【功能】益气复脉，活血化瘀，养阴生津（D错）。木瓜丸：【功能】祛风散寒，除湿（E错）通络。